能够将外界刺激传递到牙髓并且引起相应症状的机制，是以上哪种复合体的功能
A. 牙髓-牙本质复合体
B. 牙根-牙周膜复合体
C. 牙槽骨-牙周膜复合体
D. 年轻恒牙根尖乳头
E. 发育期根端复合体

正确答案：A。牙髓-牙本质复合体

解析：牙髓牙本质复合体中牙本质突起可以将感受到的刺激传递至牙髓，并引起相应的症状。掌握“牙体、牙周组织的形成”知识点。